口腔内主要致龋链球菌是
A. 轻链球菌
B. 血链球菌
C. 变形链球菌
D. 唾液链球菌
E. 米勒链球菌

正确答案：C。变形链球菌

解析：本题考查口腔内主要的致龋链球菌。变形链球菌（C对）为口内主要致龋链球菌。轻链球菌（A错）为牙菌斑中的细菌，可引起牙周炎症。血链球菌（B错）的数量与龋病损害的出现呈反比。唾液链球菌（D错）为口腔正常菌群，对人类无致龋性。米勒链球菌（E错）群是人体的正常菌群，近年来发现该菌群与化脓性感染及脓肿密切相关，是口腔和内脏链球菌性脓肿最常见的病因之一。